发于皮里膜外、筋肉骨节之间有囊性感的包块称为
A. 结核
B. 毒
C. 痰
D. 痈
E. 肿疡

正确答案：C。痰

解析：结核：即结聚成核、结如果核之意。是泛指一切皮里膜外浅表部位的病理性肿块（A错）。毒：凡是导致机体阴阳平衡失调，对机体产生不利影响的因素统称为毒（B错）。痰：指发于皮里膜外、筋肉骨节之间，或软或硬，或按之有囊性感的包块，属有形之征，多为阴证（C对）。痈：痈者，壅也。指气血被邪毒壅聚而发生的化脓性疾病（D错）。肿疡：指体表外科疾病尚未破溃的肿块（E错）。